关于溶血性链球菌感染，下列哪项是错误的
A. 不易扩散、感染局限
B. 脓液稀薄
C. 易导致败血症
D. 是蜂窝织炎、丹毒等的常见致病菌
E. 常有转移性脓肿

正确答案：A。不易扩散、感染局限

解析：本题考查软组织急性感染。关于溶血性链球菌感染，不易扩散、感染局限（A错，为本题正确答案）是错误的。溶血性链球菌可以引起丹毒或者急性蜂窝织炎，其脓液分散，稀薄，可出现转移性脓肿。